关于显微血管缝合与开放描述正确的是
A. 先吻合静脉、先开放静脉
B. 先吻合动脉、先开放动脉
C. 先吻合动脉、先开放静脉
D. 先吻合静脉、先开放动脉
E. 以上都不对

正确答案：A。先吻合静脉、先开放静脉

解析：显微血管缝合通常先吻合静脉，后吻合动脉。开放血管时也应先开放静脉，后开放动脉。检查血循情况除观察动脉搏动外，还应行静脉通畅试验检查。掌握“口腔颌面部后天畸形概论”知识点。